功能失调性子宫出血包括
A. 月经周期不规则
B. 经期延长
C. 经量增多
D. 月经异常
E. 以上全包括

正确答案：E。以上全包括

解析：本题考查功能失调性子宫出血的临床表现。更年期妇女的月经紊乱主要原因是出现排卵障碍，并非是因为生殖器官的器质性疾病或因全身性疾病引起的月经变化，所以这个时期的功血一般归类为无排卵性功能失调性子宫出血。临床可表现为月经周期不规则，周期可以提前也可以延长或者更甚没有周期性，表现为出血不止或淋漓不净（E对ABCD错）。